下列除哪一项外均是月经的特点
A. 伴随卵巢周期性变化的子宫内膜脱落出血
B. 性成熟的主要特征
C. 月经来潮的第一天至下次月经第一天为1个月经周期
D. 分为4个阶段
E. 月经第一次来潮称初潮

正确答案：D。分为4个阶段

解析：本题考查月经周期的相关内容。一般来说，月经可分为3个阶段（D错，为本题正确答案），即增殖期，分泌期，月经期。月经第一次来潮称初潮（E对），月经来潮是性成熟的主要特征（B对），是伴随卵巢周期性变化的子宫内膜脱落出血（A对），其第一天至下次月经第一天为1个月经周期（C对）。